男，34岁。近1个月来多次因阵发性恐惧、胸闷、濒死感在医院急诊科就诊，症状持续约半小时后消失。多次查血常规心电图及头颅CT等未见明显异常。患者为此担心苦恼，但仍能坚持工作。长期治疗最适当的药物是
A. 地西泮
B. 甲巯咪唑
C. 硝酸甘油
D. 帕罗西汀
E. 普萘洛尔

正确答案：D。帕罗西汀

解析：该男性患者近1个月来反复出现阵发性恐惧、胸闷、濒死感，持续时间半小时左右，故最可能诊断为惊恐发作（急性焦虑性发作）。苯二氮卓类药物（BZD）治疗惊恐发作起效快，但容易产生依赖性，不适合长期服用。帕罗西汀（SSRIs）治疗惊恐障碍有效，作用的广谱性使其更适合患者使用，且无滥用和依赖倾向，适合长期使用（D对）。甲巯咪唑适用于各种类型的甲状腺功能亢进（B错）。硝酸甘油主要用于冠心病心绞痛的治疗及预防（C错）。普萘洛尔（心得安）为β-受体阻断剂，可用于心律失常，亦可用于甲状腺功能亢进（E错）。